主要用于治疗1型糖尿病、糖尿病合并感染以及酮症的药物是
A. 胰岛素
B. 磺脲类口服降糖药
C. 双胍类口服降糖药
D. α-葡萄糖苷酶抑制剂
E. 噻唑烷二酮类药物

正确答案：A。胰岛素

解析：本题考查降糖药。Ⅰ型糖尿病开始即需要选用胰岛素（A对）治疗，胰岛素还可用于治疗糖尿病合并感染以及酮症。磺脲类口服降糖药（B错）用于治疗2型非肥胖型糖尿病。二甲双胍（C错）是治疗2型肥胖型糖尿病的首选。α-葡萄糖苷酶抑制剂（D错）是单纯餐后血糖高，而空腹和餐前血糖不高的首选。胰岛素增敏剂噻唑烷二酮（E错）是餐后血糖升高为主，伴餐前血糖轻度升高的首选。